患牙既有牙周袋、牙槽骨破坏，又有牙髓坏死，根尖周骨质破坏，且两方面病损相通，对此病变应诊断为
A. 牙周创伤
B. 成人牙周炎
C. 边缘性龈炎
D. 青少年牙周炎
E. 牙周-牙髓联合病变

正确答案：E。牙周-牙髓联合病变

解析：本题考查牙周-牙髓联合病变。该患者既有牙周病变，又有牙髓病变，且两方面病损相通，符合牙周-牙髓联合病变（E对）的定义。牙周创伤（A错）病损局限于牙周组织，可表现为牙齿松动、牙槽骨吸收；成人牙周炎（B错）即慢性牙周炎，表现为牙龈炎症、附着丧失、牙周袋形成、牙槽骨吸收；边缘性龈炎（C错）即慢性牙龈炎，表现为牙龈的炎症，一般位于游离龈和龈乳头；青少年牙周炎（D错）即局限型侵袭性牙周炎，典型表现为患牙局限于第一恒磨牙和切牙，有深牙周袋和牙槽骨破坏，第一磨牙的邻面有垂直型骨吸收，切牙区为水平型骨吸收，但这些病均无牙髓坏死，都不符合该病变的描述。